不协调性子宫收缩乏力主要表现错误的是
A. 自觉宫缩减弱
B. 拒按子宫
C. 烦躁不安
D. 宫口扩张缓慢
E. 胎先露不能下降

正确答案：A。自觉宫缩减弱

解析：不协调性宫缩乏力表现为子宫收缩性导致，宫缩兴奋点不始字两侧子宫角部，而来自子宫下段一处或多处，子宫收缩波由下向上扩散，失去正常对称性、节律性和极性，宫缩时宫底部收缩不强，而是子宫下段强，间歇时子宫不能完全放松，宫口扩张及胎先露下降缓慢或停滞（DE对），呈无效宫缩。产妇自觉宫缩强（A错，为本题正确答案），下腹持续疼痛，拒按子宫（B对），烦躁不安（C对），胎位触之不清，胎心不规律。